患者，女，27岁。结婚2年未孕，月经2～3月一行，量或多或少，头晕耳鸣，腰酸腿软，舌淡，苔薄，脉沉细。治疗应首选的方剂是
A. 开郁种玉汤
B. 养精种玉汤
C. 归肾丸
D. 毓麟珠
E. 温胞饮

正确答案：D。毓麟珠

解析：患者为年轻女性，结婚两年未孕，属不孕症，月经后期，量或多或少，头晕耳鸣，腰酸腿软，可判断患者为肾气虚，又根据患者舌苔脉象，舌淡，苔薄，脉沉细，符合肾气虚弱的舌苔脉象，故治疗应首选的方剂为毓麟珠（D对）。肾阴虚证 证候∶婚久不孕，月经先期，量少或量多，色红无块，形体消瘦，腰酸，头目眩晕，耳鸣，五心烦热。舌红苔少，脉细数。治法∶滋阴养血，调冲益精。方药∶养精种玉汤（B错）合清骨滋肾汤。肝气郁结证 证候∶婚久不孕，经前乳房、小腹胀痛，月经周期先后不定，经血夹块，情志抑郁或急躁易怒，胸胁胀满。舌质暗红，脉弦。治法∶疏肝解郁，养血理脾。方药∶开郁种玉汤（A错）。归肾丸具有补阴益阳，养血填精之功效。主治肾水真阴不足，精衰血少，腰痠脚软，形容憔悴，遗泄阳衰（C错）。温胞饮主要用于妇人胞宫寒冷不孕等病症（E错）。